记录伴随症状与主要症状之间的相互关系等情况的属于
A. 发病情况
B. 伴随症状
C. 发病以来诊治经过及结果
D. 发病以来一般情况
E. 主要症状特点及其发展变化情况

正确答案：B。伴随症状

解析：伴随症状：记录伴随症状，描述伴随症状与主要症状之间的相互关系。掌握“口外病史记录”知识点。